与女子胞功能有关的生理因素是
A. 天癸的作用
B. 冲脉的作用
C. 督脉的作用
D. 任脉的作用
E. 心、肝、脾三脏的作用

正确答案：A、B、D。天癸的作用；冲脉的作用；任脉的作用

解析：本题考查的是影响女子胞功能的生理因素。与女子胞功能有关的生理因素是天癸的作用（A对）、冲脉的作用（B对）与任脉的作用（D对）。影响女子胞功能的生理因素：（1）肾中精气和天癸的作用；（2）肝气肝血的作用；（3）冲任二脉的作用。督脉的作用（C错）：（1）调节阳经气血，故称“阳脉之海”。（2）与脑、髓和肾的功能有关。